对生态系统描述不正确的是
A. 是在一定空间范围内，由生物群落及其环境组成
B. 使生物圈内能量和物质循环的一个功能单位
C. 借助于各种功能流（物质流、能量流和信息流）所连接的稳态系统
D. 构成生物群落的生物是生态系统的主体
E. 生态系统是一个封闭的系统

正确答案：E。生态系统是一个封闭的系统

解析：本题考查生态系统的相关内容。生态系统是在一定空间范围内，由生物群落及其环境组成（A对），借助于各种功能流（物质流能量流、物种流和信息流）所联结的稳态系统（C对）。生态系统是不断进行着物质循环和能量流的功能单位（B对），由非生物物质、生产者、多级消费者和分解者组成。生态系统不是孤立的、封闭的（E错，为本题正确答案），而是通过各种途径与外界沟通，不断地与环境进行物质交换。